小儿4个月，人工喂养，平时易惊，多汗，睡眠少，近2日来咳嗽低热，今晨突然双眼凝视，手足抽动。查体：枕后有乒乓球感。患儿最可能是
A. 血糖降低
B. 血清钙降低
C. 血清镁降低
D. 血清钠降低
E. 脑脊液细胞数增多

正确答案：B。血清钙降低

解析：4个月患儿有枕后乒乓球感、双眼凝视、手足抽动的临床变现，可诊断为维生素D缺乏性手足搐搦症。维生素D缺乏性手足搐搦症的维生素D缺乏，使钙的吸收障碍，从而导致血清钙降低（B对）。血糖降低一般会有清晨空腹、进食不足或腹泻的病史，因此该患儿不会出现血糖降低的情况（A错）。虽然血清镁降低与血清钙降低的临床表现非常相似，都会有手足抽动的表现，但血清镁降低没有维生素D缺乏性佝偻病的病史（枕后有乒乓球感是维生素D缺乏性佝偻病的特征性表现），可知该患儿不会有血清镁降低（C错）。血清钠降低一般见于幼儿腹泻的情况，会有眼窝凹陷、皮肤干燥、口渴等脱水的表现（D错）。脑脊液细胞数增多的临床表现为头剧烈疼痛、颅缝增大、频繁呕吐，与该患儿的表现不符（E错）。